腺病毒肺炎典型的临床表现主要是
A. 发热、咳嗽，早期出现肺部细湿啰音
B. 持续高热、伴刺激性干咳，肺部体征出现较晚
C. 持续性发热，伴有憋喘，肺实变体征
D. 反复发作呼气性呼吸困难
E. 咳大量脓痰或反复咯血

正确答案：C。持续性发热，伴有憋喘，肺实变体征

解析：腺病毒肺炎，表现为稽留热，呈阵发性喘憋，肺部病变融合时可出现实变体征（C对）。肺部体征出现较晚，但刺激性干咳为支原体肺炎的典型症状（B错），一般无反复咯血，咯血多见于支气管扩张（E错）。本病常无显著的胸部体征，病情严重者有呼吸浅速、心率增快、肺部干湿性啰音（A错）。腺病毒肺炎吸气性呼吸困难，吸气性呼吸困难见于大气道梗阻，呼气性呼吸困难是小气道堵塞（D错）。